《中国药典》检查重金属杂质的基本原理是
A. Cl⁻+Ag⁺-AgCl沉淀（白色）
B. SO₄²⁻+Ba²⁺-BaSO₄沉淀（白色）
C. 6SCN+Fe³⁺-[Fe（SCN）₆]₃-沉淀（红色）
D. S²⁻+Pb²⁺-PbS沉淀（黑色）
E. AsH₃+Ag⁺-As₃⁺+Ag（红色）

正确答案：D。S²⁻+Pb²⁺-PbS沉淀（黑色）

解析：本题考查重金属检查法的原理。硫代乙酰胺在弱酸性（pH3.5）条件下水解，产生硫化氢，与重金属离子生成黄色到棕黑色的硫化物混悬液，与一定量标准铅溶液经同法处理后所呈颜色比较，判定供试品中重金属是否符合限量规定。Pb²⁺+H₂S→PbS↓+2H⁺（D对）。